患者，男，55岁。右上腹胀痛、消瘦2个月，发热1周。查体：体温38.5度，皮肤巩膜轻度黄染，肋下3.0cm触及，质硬，有结节。最有助于确诊的检查是
A. 腹部B超
B. 血清AFP定性
C. 腹部CT
D. 肝穿刺病理检查
E. 异常凝血酶原检查

正确答案：D。肝穿刺病理检查

解析：临床上最有助于肝癌确诊的检查是肝穿刺病理检查（D对），在超声或CT引导下用细针穿刺病变部位，吸取病变组织进行病理学检查，阳性者即可确诊。腹部B超（A错）对早期定位诊断有较大价值，彩色多普勒血液成像可分析测量肿瘤的血流，根据病灶的血供情况，有助于鉴别病变的良恶性质。血清AFP定性（B错）是目前特异性的标志物和主要诊断指标，现已广泛用于肝细胞癌的普查、诊断、疗效判断、预测复发。腹部CT（C错）是目前诊断小肝癌和微小肝癌的最佳方法。异常凝血酶原检查（E错）对亚临床肝癌有早期诊断价值。